可作为氯霉素滴眼剂pH调节剂的是
A. 10%HCl
B. 硼砂
C. 尼泊金甲酯
D. 硼酸
E. 硫柳汞

正确答案：B、D。硼砂；硼酸

解析：本题考查滴眼剂的附加剂。硼砂（B对）和硼酸（D对）可作为氯霉素滴眼剂pH调节剂；尼泊金甲酯（C错）和硫柳汞（E错）为常用抑菌剂。